属于混合性的脑神经为
A. 第Ⅲ、Ⅶ、Ⅸ、X对脑神经
B. 第V、Ⅶ、Ⅸ、X对脑神经
C. 第Ⅲ、Ⅳ、V、Ⅵ对脑神经
D. 第Ⅸ、X、Ⅺ对脑神经
E. 第Ⅵ、Ⅶ、Ⅷ对脑神经

正确答案：B。第V、Ⅶ、Ⅸ、X对脑神经

解析：12对脑神经中，属于混合性的脑神经为第V对（三叉神经）、第VII对（面神经）、第IX对（舌咽神经）、第X对（迷走神经）脑神经（B对）。第III对（动眼神经）（AC错）、第IV对（滑车神经）（C错）、第VI对（展神经）（C对）、第XI对（副神经）（D错）脑神经属于运动性神经。第VIII对（前庭蜗神经）（E错）脑神经属于感觉性神经。